中年人的心身特点
A. 个性的成熟与稳定
B. 智力发展到最佳状态
C. 生理上从成熟走向衰退
D. B+C
E. A+B+C

正确答案：E。A+B+C

解析：中年人的心身特点：①生理上从成熟走向衰退；②智力发展到最佳状态；③个性的成熟与稳定。掌握“不同年龄阶段心理卫生”知识点。